氨由骨骼肌组织通过血液向肝进行转运的机制是
A. 三羧酸循环
B. 鸟氨酸循环
C. 葡萄糖-丙氨酸循环
D. 甲硫氨酸循环
E. ATP循环

正确答案：C。葡萄糖-丙氨酸循环